心理治疗医生是否成熟称职的重要条件及心理治疗成败的关键是
A. 医生的技术水平
B. 心理治疗实施的计划性
C. 是否坚持保密原则
D. 建立良好的医患关系
E. 治疗方法的灵活性

正确答案：D。建立良好的医患关系

解析：医患关系是指医生与患者在健康与疾病问题上建立起来的真诚、信任、彼此尊重的人际关系，是一种特殊的人际关系。在诊治病人的过程中，医患关系非常重要。心理治疗中的一环关系指在治疗者与患者之间为达到治疗目的而建立的一种密切的、有感情交流的职业性帮助关系，这种医患关系比临床其他领域中谈到的医患关系更具有特殊性和重要性。合格的治疗师都有一系列共同咨询特质，即治疗者在治疗过程中对疗效有直接影响的因素，是他表现出来的人际反应特点或态度，如治疗者的温暖、真诚、尊重、积极关注和共情等特点。因此，心理治疗医生是否成熟称职的重要条件及心理治疗成败的关键是建立良好的医患关系（D对），医生的技术水平（A错）、心理治疗实施的计划性（B错）、是否坚持保密原则（C错）、治疗方法的灵活性（E错）是影响心理治疗成败的因素，但不是关键因素。